促使胰液中各种酶分泌的重要体液因素是
A. 促胃液素
B. 促胰液素
C. 胆盐
D. HCl
E. 缩胆囊素

正确答案：E。缩胆囊素